下列属于抗菌药的是
A. 盐酸氯胺酮
B. 盐酸哌替啶
C. 尼可刹米
D. 呋喃妥因
E. 依他尼酸

正确答案：D。呋喃妥因

解析：本题考查抗菌药。呋喃妥因（D对）是合成抗菌药，抗菌谱较广。盐酸氯胺酮（A错）为静脉全麻药。盐酸哌替啶（B错）为强效镇痛药。尼可刹米（C错）作用于呼吸中枢，使呼吸加深加快。依他尼酸（E错）为苯氧乙酸利尿药。